在一个乳腺癌与产次关系的病例对照研究中，研究结果表明100例乳腺癌患者有25人未产，100例对照有10人未产，那么未产使妇女患乳腺癌的危险增大
A. 2.0倍
B. 3.0倍
C. 2.5倍
D. 1.0倍
E. 1.5倍

正确答案：B。3.0倍